第9胸椎棘突下，旁开1.5寸的穴位是
A. 大杼
B. 肺俞
C. 肝俞
D. 脾俞
E. 三焦俞

正确答案：C。肝俞

解析：肝俞定位第9胸椎棘突下，旁开1.5寸（C对）。大杼定位第一胸椎棘突下，旁开1.5寸（A对）。肺俞定位第3胸椎棘突下，旁开1.5寸（B错）。脾俞定位第11胸椎棘突下，旁开1.5寸（D错）。三焦俞定位第1腰椎棘突下，旁开1.5寸（E错）。